下列有关SARS进展期的叙述，错误的是
A. 多发生在病程的8～14天
B. 胸闷气促呼吸困难等进行性加重
C. 发热及感染中毒症状持续存在
D. 肺部阴影发展迅速
E. 多数患者出现ARDS

正确答案：E。多数患者出现ARDS

解析：SARS进展期在发病8～14日（A对），病情达到高峰。发热、乏力等感染中毒症状加重（C对），并出现频繁咳嗽、活动则气喘、心悸胸闷、呼吸困难，肺实变体征进一步加重（BD对），易继发呼吸道感染。少数患者出现ARDS而危及生命（E错，为本题正确答案）。